卵巢肿瘤最常见的并发症是
A. 破裂
B. 恶变
C. 感染
D. 瘤体内出血
E. 蒂扭转

正确答案：E。蒂扭转

解析：卵巢肿瘤中最常见的并发症是蒂扭转（E对），约10%卵巢肿瘤可发生，发生蒂扭转后，因静脉回流受阻，瘤内充血或血管破裂致瘤内出血（D错）；其次是卵巢肿瘤破裂（A错），约3%卵巢肿瘤可发生；感染（C错）较少见；恶变（B错）极少见，若肿瘤迅速生长尤其双侧性，应考虑有恶变可能。